不属于环境对人类健康影响危险度的评价的是
A. 危害鉴定
B. 暴露鉴定
C. 危险度检测
D. 剂量-反应关系评定
E. 危险度特征分析

正确答案：C。危险度检测

解析：危险度检测（C错，为本题正确答案）不属于环境对人类健康影响危险度的评价。环境有害因素危险度评价的组成包括：①危害鉴定：②暴露评价：③剂量-反应关系评价：④危险度特征分析。